膀胱癌最常见的组织类型是
A. 非上皮性肿瘤
B. 鳞状细胞癌
C. 腺癌
D. 绒毛膜上皮癌
E. 移行细胞癌

正确答案：E。移行细胞癌

解析：膀胱癌绝大多数来自上皮组织，最常见的组织类型是移行细胞癌（E对），其次为鳞癌（B错）和腺癌（C错）。其余类型为非上皮性肿瘤（A错）。绒毛膜癌是来自妊娠绒毛滋养层上皮的高度侵袭性肿瘤（D错）。